某女，30岁，患风痰癫痫，某中医建议其服遂心丹，将丹逐研末入猪心内煨过，与朱砂为丸服，药师在配药时，为保证用药安全，特向患者介绍了甘遂与朱砂的注意事项。其中，甘遂的使用注意事项主要有
A. 孕妇忌服
B. 不能与甘草同用
C. 虚寒阴水者忌服
D. 痰饮停滞者忌用
E. 不可连续和过量服

正确答案：A、B、C、E。孕妇忌服；不能与甘草同用；虚寒阴水者忌服；不可连续和过量服

解析：本题考查的是甘遂的使用注意。其中，甘遂的使用注意事项主要有孕妇忌服（A对）、不能与甘草同用（B对）、虚寒阴水者忌服（C对）与不可连续和过量服（E对）。甘遂：【使用注意】本品峻泻有毒，故孕妇及虚寒阴水者忌服，体弱者慎服，不可连续或过量服用。对消化道有较强的刺激性，服后易出现恶心呕吐、腹痛等副作用，用枣汤送服或研末装胶囊吞服，可减轻反应。反甘草，不宜与甘草同用。